组成中含有菖蒲，远志的方剂是
A. 三仁汤
B. 九仙散
C. 连朴饮
D. 桑螵蛸散
E. 甘露消毒丹

正确答案：D。桑螵蛸散

解析：桑螵蛸散方含桑螵蛸甘咸平，补肾固精止遗，为君药。臣以龙骨收敛固涩，且镇心安神；龟甲滋养肾阴，补心安神。佐以人参大补元气，配茯神合而益心气、宁心神；当归补心血，与人参合用，能补益气血；菖蒲、远志安神定志，交通心肾（D对），意在补肾涩精，宁心安神的同时，促进心肾相交。诸药共奏调补心肾、补养气血、涩精止遗之功。三仁汤方含杏仁、飞滑石、白通草、白蔻仁、竹叶、厚朴、生薏苡仁、半夏（A错）。九仙散方含人参、款冬花、桑白皮、桔梗、五味子、阿胶、乌梅、贝母、罂粟壳（B错）。连朴饮方含制厚朴、川连、石菖蒲、制半夏、香豉、焦栀、芦根（C错）。甘露消毒丹方含飞滑石、淡黄芩、绵茵陈、石菖蒲、川贝母、木通、藿香、连翘、白蔻仁、薄荷、射干（E错）。